20世纪60年代末美国学者布瑞斯洛提出7种基本健康行为，下列哪项不属于健康行为
A. 正常规律的三餐，不吃零食
B. 适量运动
C. 尽可能多睡
D. 不吸烟
E. 不饮酒

正确答案：C。尽可能多睡